关于室内小气候的确切概念是
A. 人体周围环境中的气温、气湿、气流辐射等所形成的气候
B. 室外的气温、气湿、气流、辐射所形成的气候
C. 大气的温度、湿度、气流、气压所形成的气候
D. 局部环境气温、气湿、气流、气压所形成的气候
E. 室内由于围护结构的作用形成了与室外不同的室内气候

正确答案：E。室内由于围护结构的作用形成了与室外不同的室内气候

解析：本题考查室内小气候。室内小气候是指住宅的室内由于屋顶、地板、门窗和墙壁等围护结构以及室内的人工空气调节设备等综合作用，形成了与室外不同的室内气候（E对ABCD错）。主要是由气温、气湿、气流和热辐射（周围墙壁等物体表面温度）等四个气象因素组成。